男性，22岁，半年前起病，表现：有时头痛头昏，部位不定，未予处理，话多，要办一个1000人的工厂，要当经理。周游全世界，有好几个女朋友，情绪高涨。诊断躁狂症，经碳酸锂，氯丙嗪治疗后症状消失。神经系统检查无异常，2个月后意识清楚，情感淡漠，话少动作缓慢，不洗澡，不换衣服，记忆力好，无自杀观念，阵发性剧烈头痛，用头撞墙，每次半小时左右，曾癫痫大发作1次，喷射性呕吐1次。神经系检查，眼底视乳头水肿，右侧肢体肌张力增高，巴氏征阳性。脑电图中度异常，大量病理高波幅θ波。左侧较多，脑超声波中线向右移0.3cm。首先应做哪项检查
A. 头部CT
B. 复查脑电图
C. CSF
D. 抑郁症评定量表
E. 躁狂症评定量表

正确答案：A。头部CT

解析：青年男性患者头痛头晕，后出现精神障碍。曾癫痫大发作一次（脑肿瘤病人的癫痫发病率高达30%~50%），喷射性呕吐一次，眼底视神经盘水肿（提示有颅内压增高），右侧肢体肌张力增高，巴氏征阳性（提示神经功能缺损）。故应先考虑是否为脑器质性疾病，即应做头部CT（A对），检查是否有脑部肿瘤。